胎儿先露部的指示点与母体骨盆的关系
A. 胎方位
B. 胎先露
C. 骨盆轴
D. 胎姿势
E. 胎产式

正确答案：A。胎方位

解析：胎儿先露部的指示点与母体骨盆的关系称为胎方位（A对）。胎先露（B错）为最先进入骨盆入口的胎儿部分。骨盆轴（C错）为连接骨盆各平面中点的假想曲线。胎姿势（D错）为胎儿在子宫内的姿势。胎产式（E错）为胎体纵轴与母体纵轴的关系。